慢性肾小球肾炎高血压型的主要特点是
A. 轻度水肿
B. 大量蛋白尿
C. 中度以上高血压
D. 肾衰竭
E. 贫血

正确答案：C。中度以上高血压

解析：慢性肾小球肾炎分为普通型、高血压型及肾病型。普通型患者最为常见，患者可有无力，疲倦，腰部酸痛，食欲不振等表现。高血压型以中度以上高血压为主要特点（C对）。肾病型的主要特点是大量蛋白尿（B错）。